下列检测病毒感染的方法中，不是检查病毒抗体的试验方法是
A. 直接免疫荧光
B. 酶联免疫吸附试验（ELISA）
C. 血凝试验
D. 中和试验
E. 血凝抑制试验

正确答案：C。血凝试验